具有黄颜色的生物碱是
A. 喜树碱
B. 蛇根碱
C. 咖啡因
D. 长春碱
E. 毒芹碱

正确答案：B。蛇根碱

解析：本题考查的是蛇根碱的理化性质。具有黄颜色的生物碱是蛇根碱（B对）。绝大多数生物碱为无色或白色，仅少数分子中具有较长共轭体系和助色团者有一定的颜色，如小檗碱、蛇根碱呈黄色，药根碱、小檗红碱呈红色等。喜树碱（A错）在强碱性溶液中加热，其内酯（或内酰胺）结构可开环形成羧酸盐而溶于水中，酸化后环合析出。喜树碱不溶于有机溶剂，而溶于酸性三氯甲烷。咖啡因（C错）具升华性，可用升华法提取。长春碱（D错）为长春花的主要化学成分之一，具有抗癌作用。毒芹碱（E错）为小分子生物碱，为液体。